有关空胶囊的叙述，错误的是
A. 空胶囊的制备过程大致分为溶胶、蘸胶、干燥、拔壳、截割、整理等工序
B. 制备空胶囊时环境温度应控制在10℃～25℃
C. 制备空胶囊时环境的相对湿度应控制在35%-45%
D. 制备空胶囊时环境空气的洁净度应为10006级
E. 0号空胶囊的容积小于1号空胶囊

正确答案：E。0号空胶囊的容积小于1号空胶囊